以下关于急腹症手术适应证的描述最恰当的是
A. 急性胰腺炎，血淀粉酶不高者不考虑手术
B. 消化道穿孔不是剖腹手术的绝对适应证
C. 肠梗阻只有明确诊断绞窄时才可手术
D. 粘连性肠梗阻不需手术治疗
E. 先有发热的急性腹痛，一般是外科急腹症，均应考虑手术

正确答案：B。消化道穿孔不是剖腹手术的绝对适应证

解析：临床上消化性溃疡引起的穿孔大多经内科治疗便可痊愈，若穿孔后出现轻中度腹膜刺激征先保守治疗，仅腹膜刺激征严重的患者才需手术，所以消化道穿孔不是剖腹手术的绝对适应证（B对）。急性胰腺炎患者多有血淀粉酶升高的表现，但只有胰液外漏引起重度腹膜刺激征时，患者才需手术，一般急性胰腺炎患者多采取内科治疗，故血淀粉酶升高不是急性胰腺炎患者手术的指征（A错）。消化道穿孔肠梗阻发生后，单纯性肠梗阻可先行非手术治疗，绞窄性和完全性梗阻常并发缺血，导致肠壁发生缺血坏死，所以应行手术，解除梗阻，而并非只有明确诊断绞窄时才可手术（C错）。粘连性肠梗阻易发生完全梗阻或出现绞窄性梗阻，可因肠壁缺血而坏死，为避免病情恶化，应及时进行手术治疗（D错）。患者先有发热和急性腹痛等表现的急腹症，应先判断急腹症的原因，若其原因为胰液外漏等原因，应及时进行手术治疗，若其原因为腹膜感染，则无需进行手术，所以伴有发热的急腹症无需都行手术（E错）。